较易发生淋巴结转移的肿瘤是
A. 舌癌
B. 基底细胞癌
C. 多形性腺瘤
D. 唇癌
E. 腺淋巴瘤

正确答案：A。舌癌

解析：本题考查较易发生淋巴结转移的肿瘤。较易发生淋巴结转移的肿瘤是舌癌（A对），且转移率较高，因为舌体具有丰富的淋巴管和血液循环，机械运动频繁。基底细胞癌（B错）几乎不发生转移。多行性腺瘤（C错）生长缓慢，可数年或十余年不发生变化，晚期的恶性肿瘤可破溃并在颈侧区有淋巴结转移。唇癌（D错）的淋巴结转移一般较其他口腔癌为少见，且转移时间较迟。腺淋巴瘤（E错）即沃辛瘤，其组织发生虽与淋巴结有关，但转移率却很低。